医疗机构购进药品，逐批查验，并建立真实完整的记录，执行的制度是
A. 进货验收制度
B. 效期管理制度
C. 采购管理制度
D. 保管、养护管理制度
E. 拆零调配管理制度

正确答案：A。进货验收制度

解析：本题考查医疗机构药品购进和储存。医疗机构购进药品，逐批查验，并建立真实完整的记录，执行的制度是进货验收制度（A对）。《医疗机构药品监督管理办法（试行）》第二章药品购进和储存第九条：医疗机构必须建立和执行进货验收制度，购进药品应当逐批验收，并建立真实、完整的药品验收记录。医疗机构接受捐赠药品、从其他医疗机构调入急救药品也应当遵守前款规定。第十四条：医疗机构应当制定和执行药品保管、养护管理制度（D错），并采取必要的控温、防潮、避光、通风、防火、防虫、防鼠、防污染等措施，保证药品质量。第十六条：医疗机构应当建立药品效期管理制度（B错）。药品发放应当遵循“近效期先出”的原则。第三章药品调配和使用第二十条：医疗机构应当建立最小包装药品拆零调配管理制度（E错），保证药品质量可追溯。